提高患者用药依从性的方法包括
A. 简化治疗方案
B. 改善服务态度
C. 加强用药指导
D. 改进药品包装
E. 作用基本药物

正确答案：A、B、C、D。简化治疗方案；改善服务态度；加强用药指导；改进药品包装

解析：本题考查提高患者依从性的方法。用药依从性是患者遵守医师制定的药物治疗方案，服从用药指导。药物治疗的效果不仅取决于医师的正确用药，更取决于患者是否遵医嘱用药。提高患者用药依从性的方法有：（1）简化治疗方案（A对），如尽量选择缓控释制剂等长效制剂，避免需一日多次用药的短效制剂。（2）改善服务态度（B对），加强医患之间的沟通，建立相互信任，彼此尊重的关系。（3）加强用药指导（C对），尤其对毒副作用较大的药品以及一些特殊用药方法应反复详细地给患者交代。（4）改进药品包装（D对），如尽量做成单剂量的或1天量的特殊包装。